肺炎链球菌可形成
A. 荚膜
B. 芽胞
C. 鞭毛
D. 菌毛
E. 异染颗粒

正确答案：A。荚膜